关于超敏反应正确理解是
A. 初次接触Ag即可能发生
B. 机体反应性处于低状态
C. 不是特异性
D. 属于正常免疫应答
E. 属于异常免疫应答

正确答案：E。属于异常免疫应答

解析：超敏反应又称变态反应，是指机体再次接触相同的抗原时所发生的引起机体生理功能紊乱或组织损伤的特异性免疫应答。掌握“概述及Ⅰ型超敏反应”知识点。